单根牙的形成中，下列哪项组织能够诱导牙髓细胞形成成牙本质细胞
A. 上皮隔
B. 上皮根鞘
C. 牙囊
D. 牙乳头
E. 内釉上皮

正确答案：B。上皮根鞘

解析：在单根牙形成中，上皮根鞘的内层细胞诱导邻近的牙髓细胞，分化成为成牙本质细胞进而形成牙本质。掌握“牙体、牙周组织的形成”知识点。